适宜使用洋地黄类药物的情况是
A. 快速心房颤动
B. 三度房室传导阻滞
C. 预激综合征伴心房颤动
D. 病态窦房结综合征
E. 二度Ⅱ型房室传导阻滞

正确答案：A。快速心房颤动

解析：洋地黄可作用于迷走神经传入纤维，增加心脏压力感受器的敏感性，在房颤时延缓房室传导，从而减慢房颤的心室率，且不增加心肌耗氧量，因此洋地黄最适宜治疗快速心房颤动（A对）。一般剂量下，洋地黄可抑制心脏传导系统，对房室交界区的抑制最为明显，因此对三度房室传导阻滞（B错）、二度Ⅱ型房室传导（E错）阻滞患者不宜使用。洋地黄可缩短旁路不应期导致更多的心电活动自旁路下传而加快心室率，因而不宜应用于预激综合征伴心房颤动（C错）。病态窦房结综合征（P184）（D错）是由窦房结病变导致功能减退，产生多种心律失常的表现，若应用洋地黄，可进一步加重窦房结功能障碍，也不宜使用。